绒毛膜促性腺激素的作用是
A. 在妊娠8～10周内维持妊娠
B. 在妊娠8～10周后继续维持妊娠
C. 增加淋巴细胞的活动达到“安胎”效应
D. 抑制黄体分泌孕酮
E. 降低母体利用糖，将葡萄糖转给胎儿

正确答案：A。在妊娠8～10周内维持妊娠